低渗性缺水时，在血清钠尚未明显降低之前，尿钠含量
A. 正常
B. 略高
C. 时高时低
D. 逐渐升高
E. 减少

正确答案：E。减少

解析：低渗性缺水是指机体失钠多于失水，故血清钠低于正常范围，细胞外液呈低渗状态。在血清钠尚未明显降低之前（即机体的代偿阶段），机体会减少抗利尿激素的分泌，使水在肾小管内的重吸收减少，尿量排出增多，从而增加细胞外液的渗透压。而尿钠是测定24h尿液中的钠离子浓度。水排出增多，尿液被稀释，尿钠含量减少（E对）。机体为避免循环血量的再减少，将不再顾及渗透压的维持（即进入失代偿阶段），肾素-醛固酮系统发生兴奋，使肾脏减少排钠，增加水、Cl⁻的重吸收，故尿钠含量继续减少。因此，无论在代偿阶段还是在失代偿阶段，低渗性缺水的尿钠都会减少。